一般情况含氟涂料应用的频率是
A. 1次/年
B. 2次/年
C. 3次/年
D. 4次/年
E. 5次/年

正确答案：B。2次/年

解析：本题考查含氟涂料。一般情况含氟涂料应用的频率是2次/年（B对）。含氟涂料是一种加入了氟化物的有机溶液，将其涂布于牙齿表面，可预防龋病。含氟涂料种类较多，最常用的有含5%氟化物和含0.9%氟化物两种浓度的含氟涂料。使用方法：使用含氟涂料非常简单，只需用小刷子或棉签将约0.3～0.5mL涂料直接涂抹于各个牙面上待其凝固即可。涂布后要求患者最好在2～4小时内不进食，当晚不刷牙，以保证涂料与牙面的最大接触。涂料一般保持24～48小时。一般情况下，含氟涂料1年两次即可达到有效的预防效果。对易患龋人群，1年可用2～4次。